颠换与转换的不同点主要在于
A. 碱基置换的类型
B. 产生的氨基酸
C. 产生的蛋白质
D. 导致的后果

正确答案：A。碱基置换的类型

解析：本题考查颠换与转换的不同点。颠换与转换的不同点主要在于碱基置换的类型（A对BCD错）。颠换是指原来的嘌呤被嘧啶置换或原来的嘧啶被嘌呤置换；转换是指原来的嘌呤被另一种嘌呤置换或原来的嘧啶被另一种嘧啶置换。